从循证医学的观点看，不同种类的研究方法提供的证据的质量差别很大，最高质量的研究方法应该是
A. 个人经验和观点
B. 无对照病例系列
C. 随机对照试验
D. 系统综述
E. 非随机对照研究

正确答案：D。系统综述

解析：本题考查系统综述的作用。进行系统综述（D对ABCE错）的目的，就是为循证医学提供最好的证据。高质量的系统综述和meta分析能为临床医生、病人和其他决策者提供科学依据。